固定桥修复缺失牙形态和功能的部分是
A. 桥体
B. 固位体
C. 连接体
D. 基牙
E. 嵌体

正确答案：A。桥体

解析：桥体：即人工牙，是固定桥修复缺失牙形态和功能的部分。掌握“固定桥的组成和分类”知识点。